以下哪种不属于非电离辐射
A. 激光
B. X射线
C. 紫外线
D. 红外线
E. 可见光

正确答案：B。X射线

解析：本题考查非电离辐射的种类。量子能最较低的电磁辐射不足以引起生物体电离，称为非电离辐射，如紫外线（C对）、可见光、红外线（D对）、射频及来源于可见光（E对）的激光（A对）。紫外线的量子能量介于非电离辐射与电离辐射之间。X射线（B错，为本题正确答案）属于电离辐射。